女，32岁，发热腰痛尿频尿急一个月，近3天全身关节酸痛尿频尿急加重。体检：体温39.5℃，白细胞13×10⁹/L，中性粒细胞86%，尿培养大肠杆菌阳性，诊断为大肠杆菌性尿路感染，应首选
A. 青霉素
B. 红霉素
C. 灰黄霉素
D. 头孢曲松
E. 林可霉素

正确答案：D。头孢曲松

解析：患者诊断大肠杆菌性尿路感染，大肠杆菌属于肠杆菌属类，首选的抗生素为头孢曲松（D对）（头孢曲松为第三代头孢菌素，对肠杆菌属类、铜绿假单胞菌及厌氧菌有较强的作用）。青霉素（A错）是治疗敏感的G⁺球菌和杆菌、G⁻球菌及螺旋体所致感染的首选药，对G⁻菌不敏感。红霉素（B错）（P379）属于大环内酯类抗生素，常用于治疗耐青霉素的金黄色葡萄球菌感染和对青霉素过敏者，也用于厌氧菌感染引起的口腔感染和肺炎支原体、肺炎衣原体所致的呼吸系统、泌尿生殖系统的感染。灰黄霉素（C错）是抗真菌药，主要用于各种皮肤癣菌的治疗。林可霉素（E错）（P381）主要用于厌氧菌的治疗，是治疗金黄色葡萄球菌引起的骨髓炎的首选药。